国家对新药审批时进行的检验属于
A. 抽查检验
B. 注册检验
C. 生产检验
D. 指定检验
E. 复验

正确答案：B。注册检验

解析：本题考查的是药品质量监督检验的类型。国家对新药审批时进行的检验属于注册检验（B对）。药品注册检验，包括标准复核和样品检验。新药上市申请、首次申请上市仿制药、首次申请上市境外生产药品，应当进行样品检验和标准复核。抽查检验（A错）是结果由药品监督管理部门以药品质量公告形式发布的检验。指定检验（D错）是指国家法律或国家药品监督管理部门规定某些药品在销售前或者进口时，必须经过指定药品检验机构检验，检验合格的，才准予销售的强制性药品检验。复验（E错）是指复验当事人对药品检验结果有异议的，可以自收到药品检验结果之日起七日内向原药品检验机构或者上一级药品监督管理部门设置或者指定的药品检验机构申请复验，也可以直接向国务院药品监督管理部门设置或者指定的药品检验机构申请复验。